首先提出痫证发生为“痰涎壅塞”所致的古典医著是
A. 《素问》
B. 《金匮要略》
C. 《千金方》
D. 《三因方》
E. 《丹溪心法》

正确答案：E。《丹溪心法》

解析：朱震亨在《丹溪心法·痫》中指出“无非痰涎壅塞，迷闷孔窍”引发本病，主张“大率行痰为主”（E对）。《素问·奇病论》曰：“人生而有病癫疾者…病名为胎病，此得之在母腹中时，其母有所大惊，气上而不下，精气并居，故令子发为癫疾也”（A错）。孙思邈《备急千金要方·论治病略例第三》首次提出“癫病”或“病”病名，并将癫病症状归纳为20条（C错）。《三因极一病证方论·癫病叙论》云：“夫癫痛病，皆由惊动，使脏气不平，郁而生涎，闭塞诸经，厥而乃成，或在母胎中受惊，或少小感风寒暑湿，或饮食不节，逆于脏气。”（D错）